儿童少年的营养需求特点是
A. 生长发育的热能需要与总热能的比例相对恒定
B. 开始青春期发育后蛋白质需要量明显增加
C. 儿童每日摄入脂肪应占总热能的30%～35%
D. 每天水的需求总量大于成人
E. 维生素需求量较恒定，变化不大

正确答案：B。开始青春期发育后蛋白质需要量明显增加

解析：本题考查儿童少年的营养需求特点。1.对热能的需要：儿童生长发育的能量是儿童所特有的，儿童在不断的生长发育的过程中，体格的快速增长都需要能量，在不同的发育阶段，消耗能量不同，占总热能的比例是不同的（A错）；2.对蛋白质的需要：蛋白质是机体组织细胞的主要成分，儿童少年生长发育迅速，故对蛋白质的需要量明显增加（B对），各种氨基酸的需要量按体重计算均较成人高；3.婴儿每日摄人脂肪应占总热能的35%～50%，年长儿为25%～30%（C错）；4.婴儿的需水量较成人相对较大，但儿童少年的需水量可与成人相当（D错）；5.儿童生长发育不同阶段对维生素的需求不同（E错）。